输尿管结石4mm，治疗方案为
A. 体外冲击波碎石
B. 输尿管镜取石
C. 开放手术治疗
D. 腹腔镜取石
E. 药物治疗以及大量饮水

正确答案：E。药物治疗以及大量饮水

解析：药物排石治疗（E对）适用于结石直径＜0.6cm、表面光滑、结石以下尿路无梗阻。在药物治的疗过程中，大量饮水增加尿量，可以稀释尿中结石物质的浓度，减少晶体沉积，促进结石排出。体外冲击波碎石（A错）适用于直径≤2cm的肾结石和输尿管上段结石（P560）。输尿管镜取石（B错）适用于中下段输尿管结石和泌尿系平片不显影的结石。开放手术治疗（C错）由于手术给病人造成较大的损伤，较少采用。腹腔镜取石（D错）适用于输尿管结石＞2cm，原考虑开放手术，或经体外冲击波碎石、输尿管镜手术治疗失败者。